某女，36岁。经血非时而下，量时多时少，时出时止，淋沥不断。经色暗，有血块；舌紫暗，边有瘀点，脉弦细。诊断为崩漏，证属瘀血阻络，治以将军斩关汤加减，方用大黄、巴戟天、仙鹤草、茯神、蒲黄、阿胶、黄芪、当归、白术、生地黄、熟地黄、谷芽。方中大黄宜选用的炮制品是
A. 生大黄
B. 熟大黄
C. 大黄炭
D. 酒大黄
E. 醋大黄

正确答案：C。大黄炭

解析：本题考查崩漏之瘀血阻络证的方剂应用。方中大黄宜选用的炮制品是大黄炭（C对）。崩漏之瘀血阻络证【症状】经血非时而下，量时多时少，时出时止，或淋沥不断，或停闭数月又突然崩中，继之漏下，经色暗有血块；舌质紫暗或尖边有瘀点，脉弦细或涩。【治法】活血化瘀，固冲止血。【方剂应用】1.基础方剂逐瘀止血汤（生地黄、大黄、赤芍、丹皮、当归尾、枳壳、龟甲、桃仁）或将军斩关汤（熟军炭、巴戟天、仙鹤草、茯神、蒲黄、炒阿胶、黄芪、炒当归、白术、生地、熟地、焦谷芽）加减。2.合理用药与用药指导（1）饮片选择：逐瘀止血汤出自清代《傅青主女科》。选用大黄炭，长于凉血化瘀止血；选用当归尾，取其擅长活血破血之功；选用醋龟甲，长于补肾健骨、滋阴止血；选用蒲黄炒阿胶，长于止血安络。生大黄、酒大黄、熟大黄与大黄炭：四种均为大黄的不同炮制品种，由于炮制方法不同，作用亦各有偏重。生大黄（A错）泻下力强，故欲攻下者宜生用，汤剂应后下，或用开水泡服；久煎则泻下力减弱。酒大黄（D错）泻下力较弱，善清上焦血分热毒，宜用于目赤咽肿，齿龈肿痛。熟大黄（B错）泻下力缓，能减轻泻下的腹痛，增强活血化瘀作用，适用于体虚而有瘀血者。大黄炭凉血化瘀止血，多用于血热有瘀出血证。